关于人类胚胎干细胞研究和应用的伦理原则，错误的是
A. 无论胚胎是不是人，都应该得到尊重
B. 需先经动物实验等措施，以符合安全和有效的原则
C. 禁止故意生产、销售、买卖配子和胚胎等，以防止商品化
D. 配子和胚胎等属于个人财产，允许买卖，符合公平的原则
E. 与病人或受试者有关的信息应充分告知

正确答案：D。配子和胚胎等属于个人财产，允许买卖，符合公平的原则

解析：本题考查人类胚胎干细胞研究和应用的伦理原则。关于人类胚胎干细胞研究和应用的伦理原则错误的是配子和胚胎等属于个人财产，允许买卖，符合公平的原则（D错，为本题的正确答案）。我国国家人类基因组南方研究中心伦理学部起草的《人类成体干细胞研究和临床应用伦理准则（建议稿）》认为，人胚胎干细胞和成体干细胞研究以及临床试验都应遵循相关的伦理原则：科学性原则；不伤害/受益原则；知情同意原则；公正性原则；公益原则；非商业化原则。故无论胚胎是不是人，都应该得到尊重（A对）；需先经动物实验等措施，以符合安全和有效的原则（B对）；禁止故意生产、销售、买卖配子和胚胎等，以防止商品化（C对）；禁止买卖人类配子、受精卵、胚胎和胎儿组织，符合非商业化原则；与病人或受试者有关的信息应充分告知（E对），符合知情同意原则。